石棉肺的主要病理改变是
A. 结节型
B. 团块型
C. 弥漫性肺间质纤维化
D. 尘斑和尘斑灶周围肺气肿
E. 胸膜增厚

正确答案：C。弥漫性肺间质纤维化